某女，30岁，平素体虚有感风邪，症见自汗恶风，面色㿠白，医师处以玉屏风胶囊，是因其能
A. 益气、固表、发汗
B. 益气、固表、止汗
C. 益气、敛汗、固脱
D. 益气、温阳、敛汗
E. 益气、养阴、止汗

正确答案：B。益气、固表、止汗

解析：本题考查的是玉屏风胶囊的功能。平素体虚有感风邪，症见自汗恶风，面色㿠白，医师处以玉屏风胶囊，是因其能益气、固表、止汗（B对）。玉屏风胶囊：【功能】益气，固表，止汗。